某女，45岁。近日常因子女学习问题气恼，头胀痛，恼怒加重，伴面色潮红，烦躁易怒，失眠多梦。宜选用的中成药是
A. 芎菊上清丸
B. 通天口服液
C. 清眩丸
D. 脑立清丸
E. 川芎茶调颗粒

正确答案：D。脑立清丸

解析：本题考查的是头痛的辨证论治。近日常因子女学习问题气恼，头胀痛，恼怒加重，伴面色潮红，烦躁易怒，失眠多梦。宜选用的中成药是脑立清丸（D对）。头痛是临床常见的自觉症状，可单独出现，亦见于多种疾病的过程中。本节所讨论的头痛，是指因外感六淫或疠气、内伤杂病而引起的，以头痛为主要表现的疾病。西医学中的血管性头痛、神经性头痛、三叉神经痛、外伤后头痛、五官科疾病的头痛以及部分颅内疾病引起的头痛等，可参考此内容辨证论治。（一）风寒头痛：【症状】头痛时作，痛连项背，常有拘急收紧感，伴恶风畏寒，受风尤剧，口不渴。舌苔薄白，脉浮紧。【中成药应用】常用中成药有川芎茶调颗粒（E错）、天麻头痛片、都梁软胶囊。（二）风热头痛：【症状】头痛而胀，甚则头痛如裂，发热或恶风，口渴欲饮，面红目赤，或便秘溲黄。舌尖红，苔黄，脉浮数。【中成药应用】常用中成药有清眩片（C错）、芎菊上清丸（A错）。（三）肝阳头痛：【症状】头昏胀痛，两侧为重，心烦易怒，夜寐不宁，口苦面红，或兼胁痛。舌红苔黄，脉弦数。【中成药应用】常用中成药有天麻钩藤颗粒、天麻首乌片、清脑降压片、脑立清丸。（四）血虚头痛：【症状】头痛隐隐，时时昏晕，心悸失眠，面色少华，神疲乏力，遇劳加重。舌质淡，苔薄白，脉细弱。【中成药应用】常用中成药有益血生胶囊、养血清脑颗粒、天麻头痛片。（五）瘀血头痛：【症状】头痛经久不愈，痛处固定不移，痛如锥刺，或有头部外伤史。舌紫暗，或有瘀斑，瘀点，苔薄白，脉细或细涩。【中成药应用】常用中成药有血府逐瘀口服液、通天口服液（B错）、逐瘀通脉胶囊、丹七片。